胰腺损伤
A. 腹膜炎出现早
B. 腹膜炎严重，呈板状腹
C. 腹膜炎出现较晚，但较重
D. 腹膜炎出现较晚且较轻
E. 无腹膜刺激征

正确答案：D。腹膜炎出现较晚且较轻

解析：胰腺损伤后，腹腔内出血量一般不多，而且血液对腹膜的刺激较小；胰腺属于腹膜后位器官，胰腺损伤后，早期外溢的胰液主要积聚在后腹膜的网膜囊内，对壁腹膜的刺激作用较弱，综上，胰腺损伤早期腹膜刺激症状不明显。胰腺损伤晚期，外渗的胰液经网膜孔进入腹腔，可引起弥漫性腹膜炎。因此，胰腺损伤引起的腹膜炎的特点是症状出现较晚且较轻（D对）。腹膜炎出现早（A错）为小肠损伤（P326）的特点。腹膜炎严重，呈板状腹（B错）为胃穿孔的特点。腹膜炎出现较晚，但较严重（C错）为结肠损伤（P326）的特点。腹膜刺激征可见于大多数腹部闭合性损伤的患者（E错）。